下列哪种因素不影响N-亚硝基化合物在体内外的合成
A. 反应物浓度
B. 硫氰酸盐
C. 水分
D. pH
E. 微生物

正确答案：C。水分